女孩，2岁，体检发现心脏杂音就诊，平素体健，查体：左缘第2肋间闻及2/6级喷射性收缩期杂音，第二心音固定分裂，ECG电轴右编，Vl导联呈rsR波型。其心脏杂音产生的机理是
A. 二尖瓣相对狭窄
B. 三尖瓣相对狭窄
C. 肺动脉瓣相对狭窄
D. 血流通过缺损处
E. 主动脉瓣相对狭窄

正确答案：C。肺动脉瓣相对狭窄

解析：患儿平素体健，查体：胸骨左缘第2肋间闻及2/6级喷射性收缩期杂音，第二心音固定分裂，查心电图示：ECG电轴右偏，Vl导联呈rsR波型，最可能的诊断是房间隔缺损。房间隔缺表现为左向右分流，右心室血容量增加，大量的血流通过正常肺动脉瓣时形成相对狭窄（C对）。二尖瓣相对狭窄（A错）听诊为心尖部舒张中晚期隆隆样杂音。三尖瓣相对狭窄（B错）较为少见，听诊为胸骨左缘4、5肋间舒张中晚期杂音。先天型主动脉瓣狭窄（E错）是婴幼儿死亡重要原因之一，听诊为胸骨右缘1～2肋间粗糙而响亮的射流性杂音，呈递增-递减型，向颈部传导。